多数脂溶性小分子类药物的吸收机制是
A. 膜孔滤过
B. 简单扩散
C. 膜动转运
D. 易化扩散
E. 主动转运

正确答案：B。简单扩散

解析：本题考查药物的转运方式。多数脂溶性小分子类药物的吸收机制是简单扩散（B对）；膜孔滤过（A错）是指水溶性的极性或非极性药物分子借助于流体静压或渗透压随体液通过细胞膜的水性通道而进行的跨膜转运；膜动转运（C错）是指生物膜通过主动变形将物质摄入细胞内或从细胞内释放到细胞外的过程；易化扩散（D错）借助载体的被动运输，不消耗能量；主动转运（E错）是指逆浓度梯度运输的过程。